津液不足引起的是
A. 内寒
B. 内风
C. 内湿
D. 内燥
E. 内火

正确答案：D。内燥

解析：内燥指体内津液耗伤而干燥少津的病机变化（D对）。内寒是指机体阳气虚衰，温煦气化功能减退，虚寒内生，或阴寒之气弥漫的病机变化（A错）。内风是指脏腑阴阳气血失调，体内阳气亢逆而致风动之征的病机变化（B错）。内湿是指由于脾气的运化水液功能障碍而引起湿浊蓄积停滞体内的病机变化（C错）。内火是指脏腑阴阳失调而致火热内扰的病机变化（E错）。